在免疫应答过程中，巨噬细胞的作用
A. 产生抗体
B. 表达TCR
C. 产生细胞因子
D. 表达CD3分子
E. 发生基因重排

正确答案：C。产生细胞因子

解析：巨噬细胞属于固有免疫细胞的一种，胞质内富含溶酶体和线粒体，具有强大的吞噬、杀菌、清除凋亡细胞及其他异物的能力，在免疫应答的过程中，可分泌多种促炎症性细胞因子IFN-γ、IL-1和IL-6等（C对）。产生抗体（A错）的细胞是浆细胞。表达TCR（B错）的细胞是T细胞。产生CD3分子（D错）的细胞是T细胞和某些胸腺细胞。只有T细胞和B细胞在免疫应答过程发生基因重排（E错）。